治疗绦虫病的首选药品是
A. 哌嗪
B. 伊维菌素
C. 吡喹酮
D. 伯氨喹
E. 噻嘧啶

正确答案：C。吡喹酮

解析：本题考查治疗绦虫病的首选药。治疗绦虫病的首选药品是吡喹酮（C对）。吡喹酮适用于各种血吸虫病、华支睾吸虫病、肺吸虫病、姜片虫病、绦虫以及绦虫病和囊虫病。哌嗪（A错）适用于蛔虫和蛲虫感染。伊维菌素（B错）是新型的广谱、高效、低毒抗生素类抗寄生虫药，对体内外寄生虫特别是线虫和节肢动物均有良好驱杀作用，但对绦虫、吸虫及原生动物无效。伯氨喹（D错）临床作为控制复发和阻止疟疾传播的首选药。噻嘧啶（E错）主要用于蛔虫、钩虫、蛲虫感染以及蛔虫、钩虫混合感染。